下面所述神经节哪个不属于副交感神经节
A. 器官壁内神经节
B. 睫状神经节
C. 下颌下神经节
D. 膝神经节
E. 耳神经节

正确答案：D。膝神经节

解析：位于颅部的副交感神经节较大，肉眼可见，有睫状神经节（B对）、下颌下神经节（C对）、翼腭神经节和耳神经节（E对）等。膝神经节（D错，为本题正确选项）属于感觉性神经节。